急性黄疸性肝炎病程一般为
A. 2个月
B. 2～4个月
C. 5个月
D. 半年
E. 半年

正确答案：B。2～4个月

解析：急性黄疸型肝炎总病程为2～4个月。可分为三期：黄疸前期持续5～7天。黄疸期持续2～6周。恢复期持续1～2个月。掌握“病毒性肝炎”知识点。